治疗甲状腺功能亢进症心肝阴虚证，应首选
A. 他巴唑加天王补心丹
B. 碘加天王补心丹
C. 他巴唑加六味地黄丸
D. 他巴唑加消瘿丸
E. 碘液加天王补心丹

正确答案：A。他巴唑加天王补心丹

解析：甲状腺功能亢进症应首选抑制甲状腺激素合成的他巴唑，心肝阴虚证，治宜滋阴降火，消瘿散结，首选滋阴养血，补心安神的天王补心丹（A对）。碘加天王补心丹治疗甲状腺功能亢进症心肝阴虚证且对抗甲状腺药物过敏者（B错）。六味地黄丸填精滋阴补肾，主治肾阴精不足证（C错）。消瘰丸清热化痰，软坚散结，适用于痰结化热之瘿病（D错）。甲状腺功能亢进症首选抑制甲状腺激素合成的他巴唑，对抗甲状腺药物过敏者，首选碘（E错）。